踝关节稳定性差，易于发生损伤的体位是
A. 跖屈位
B. 背屈位
C. 内翻位
D. 外翻位
E. 中立位

正确答案：A。跖屈位

解析：在跖屈时，距骨体与踝穴的间隙增大，因而活动度增大，使踝关节相对不稳定，所以在跖屈位时踝关节易发生损伤。